下列药物中血浆蛋白结合率最低的是
A. 阿米替林
B. 吲哚美辛
C. 双香豆素
D. 妥布霉素
E. 多西环素

正确答案：D。妥布霉素